评价脑力劳动负荷较合适的指标是
A. 体温
B. 皮温
C. 肌电
D. 肺通气量
E. 脑诱发电位

正确答案：E。脑诱发电位